患者，男，42岁。急性肾功能衰竭，经治疗后进入恢复期，症见腰膝酸软，乏力气促，手足心热，口干喜饮，舌略红苔薄少津，脉沉细数。治疗应首选
A. 生脉散
B. 六味地黄汤
C. 无比山药丸
D. 参芪麦味地黄汤
E. 知柏地黄汤

正确答案：D。参芪麦味地黄汤

解析：腰膝酸软，乏力气促为气虚的表现，手足心热，口干喜饮，舌略红苔薄少津，脉沉细数，为阴虚的表现。治宜益气养阴，方选参芪麦味地黄汤（D对）。生脉饮功能补益心气，为治疗胸痹气阴两虚证选方（A错）。六味地黄丸功能滋养肾阴，为治疗消渴下消之肾阴亏虚证选方（B错）。无比山药丸功能补肾固摄，为治疗血证尿血之肾气不固证的选方（C错）。知柏地黄丸功能滋阴降火，为治疗血证尿血之肾虚火旺证的选方 （E错）。